根据WHO规定，老年人口为
A. 55岁或60岁以上人口
B. 60岁或65岁以上人口
C. 60岁或70岁以上人口
D. 70岁或75岁以上人口
E. 70岁或80岁以上人口

正确答案：B。60岁或65岁以上人口